梨型心脏见于
A. 主动脉瓣狭窄
B. 二尖瓣狭窄
C. 肺动脉瓣狭窄
D. 三尖瓣狭窄
E. 动脉导管未闭

正确答案：B。二尖瓣狭窄

解析：梨形心，由于心尖上翘心房扩张导致。二尖瓣狭窄（B对）时，左心房压力持续上升，左心房增大，心脏呈梨形。主动脉瓣狭窄（A错），左心室血流排出受阻，左心室肥厚，X线下，呈靴形心。肺动脉瓣狭窄（C错）时，心影扩大，以右室和右房肥大为主，心尖因右室肥大呈球形向上抬起。三尖瓣狭窄（D错）时，右心房排血受阻，右心房增大，上腔静脉扩张。动脉导管未闭（E错）时，左、右心室增大，心影增大。